麻黄素单方制剂处方留存
A. 1年
B. 2年
C. 3年
D. 4年
E. 5年

正确答案：B。2年